在因果推断标准中，现在一般不包括下列哪个标准
A. 关联的时间顺序
B. 关联的强度
C. 关联的一致性
D. 关联的合理性
E. 关联的灵敏度

正确答案：E。关联的灵敏度

解析：本题考查病因推断的标准。希尔病因推断的标准包括：①时间顺序（A对）；②关联强度（B对）；③剂量-反应关系；④结果的一致性（C对）；⑤实验证据；⑥生物学合理性（D对）；⑦生物学一致性；⑧特异性；⑨相似性；⑩预测力。关联的灵敏度（E错，为本题正确答案）不是病因推断的标准。